右房肥大的心电图表现为
A. P波呈双峰状
B. P波增宽
C. P波出现切迹
D. P波尖锐高耸
E. P波低平

正确答案：D。P波尖锐高耸

解析：右心房肥大的心电图特点是：①P波电压增高∶在肢体导联Ⅱ、Ⅲ、aVF上P波电压≥0.25mV（D对E错）；P波时限≥0.12s，见于左心房肥大（AB错）。在胸前导联V₁、V₂上P波电压≥0.15mV（C错），或IPI>0.03mm·s。②P波形态高尖，在下壁导联尤为突出。③P波电轴右偏，+75°～+90°。④在QRS波群低电压的情况下，P波尖峰且振幅大于同导联R波的1/2即可诊断。